男，25岁。反复上腹部疼痛5年。反酸嗳气，最具诊断意义的检查项目是
A. 腹部B超
B. 消化道钡餐
C. 胃镜检查
D. 大便隐血试验
E. 胃液分析

正确答案：C。胃镜检查

解析：年轻男性患者，长期反复上腹痛伴反酸嗳气，考虑上消化道病变。胃镜（C对）能直接观察到被检查部位的真实情况，更可通过对可疑病变部位进行病理活检及细胞学检查，以进一步明确诊断，是上消化道病变的首选检查方法。腹部B超（A错）主要检查肝、胆、胰、脾、双肾等实质性脏器的病变。消化道钡餐（B错）适用于不愿接受胃镜检查的患者；大便隐血试验（D错）是测定消化道出血的一种方法；胃液分析（E错）可以测定BAO（基础胃酸分泌量）及MAO（最大胃酸分泌量），了解溃疡病患者胃酸分泌情况，以上三种检查对上消化道病变阳性率较胃镜低。